用于恶性肿瘤手术前后，骨折后不愈合的药物是
A. 黄体酮
B. 甲睾酮
C. 雌二醇
D. 苯丙酸诺龙
E. 醋酸甲地孕酮

正确答案：D。苯丙酸诺龙

解析：本题考查苯丙酸诺龙。苯丙酸诺龙（D对）主要用于蛋白质缺乏症，如严重灼伤、恶性肿瘤患者手术前后、骨折后不易愈合和严重骨质疏松症、早产儿生长发育显著迟缓等。黄体酮（A错）为天然孕激素，用于习惯性流产、痛经、经血过多或血崩症、闭经等。甲睾酮（B错）作为外源性睾酮补充剂，用于雄激素缺乏的替代治疗。雌二醇（C错）为天然雌激素，临床用于卵巢功能不全或卵巢激素不足引起的各种症状。醋酸甲地孕酮（E错）为高效黄体激素，用于治疗月经不调、功能性子宫出血、子宫内膜异位症。